对盐酸伪麻黄碱描述正确的是
A. 为（1S，2R）构型，右旋异构体
B. 为（1R，2S）构型，左旋异构体
C. 为（1S，2S）构型，右旋异构体
D. 为（1R，2R）构型，左旋异构体
E. 为（1R，2S）构型，内消旋异构体

正确答案：C。为（1S，2S）构型，右旋异构体